女，65岁，体检时胸部X线右下肺直径约2cm大小的类圆形结节影，患者无自觉症状，否认吸烟史，查体：双肺呼吸音清，闻及干湿啰音，为进一步明确诊断，下列检查中应首选的是
A. 痰细胞学检查
B. 血清肿瘤标志物
C. 支气管镜检查
D. 胸部增强CT
E. 密切观察，定期复查胸部X线片

正确答案：D。胸部增强CT

解析：女，65岁，体检时胸部X线右下肺直径约2cm大小的类圆形结节影，患者无自觉症状（5%～15%的肺癌患者无症状），否认吸烟史，查体：双肺呼吸音消，闻及干湿啰音。根据胸部X线及肺部查体，多考虑肺癌。为进一步明确诊断，我们采首选增强CT（D对E错）。增强CT具有更高的分辨率，能发现肿瘤的原发部位、纵膈淋巴结侵犯和其他解剖部位的播散情况。痰细胞学检查（A错）、支气管镜检查（C错）为病理学诊断的手段。怀疑肺癌的病人必须获得组织学标本诊断，但不为首选，且不推荐痰细胞学确诊肺癌。肿瘤标志物（B错）对肺癌的诊断只具有一定参考价值。